心率62次/分，双眼向右水平眼震，右手指鼻不准，右侧跟膝胫试验阳性。最可能的诊断是
A. 右小脑半球出血
B. 脑桥出血
C. 基底节区出血
D. 右枕叶出血
E. 右大脑梗死

正确答案：A。右小脑半球出血

解析：中老年男性患者， 活动中突发头痛眩晕，伴呕吐（提示颅内压增高可能）走路不稳，查体：BP180/105mmHg（正常值140/90mmHg），双眼向右水平眼震，右手指鼻不准，右侧跟膝胫试验阳性（小脑性共济失调表现）。高血压患者急性起病，且有颅内压增高及小脑性共济失调表现，考虑小脑出血，因小脑半球是控制同侧肢体的协调运动并维持正常的肌张力，故应为右小脑半球出血（A对）。脑桥出血（B错）时，患者可迅速出现昏迷、双侧针尖样瞳孔、呕吐咖啡样内容物、四肢瘫痪等表现，也可表现为交叉性瘫痪和共济失调性偏瘫。基底节区出血（C错）常有病灶对侧偏瘫、偏身感觉障碍和同向性偏盲，优势半球受累可有失语。右枕叶出血（D错）可出现视野缺损等视觉障碍。右大脑梗死（E错）可出现左侧肢体中枢性瘫痪、左侧肢体感觉障碍，双眼同向性偏盲，双眼向左侧凝视麻痹，伴有意识障碍。